女，36岁，左下腹痛，腹泻，大便次数3-5次/日，伴黏液脓血便，里急后重，反复多次粪便培养，阿米巴等均为阴性，抗生素治疗无效，距肛门50cm以上可见粘膜粗颗粒改变，点状多发糜烂及浅溃疡，可见黄色黏液覆盖，治疗
A. 环孢素
B. 蒙脱石散
C. 甲硝唑
D. 柳氮磺吡啶
E. 泼尼松

正确答案：D。柳氮磺吡啶

解析：该患者女，36岁，左下腹痛，腹泻，大便次数3-5次/日，伴黏液脓血便，里急后重（溃疡性结肠炎的表现），反复多次粪便培养，阿米巴等均为阴性，抗生素治疗无效，距肛门50cm以下可见粘膜粗颗粒改变（溃疡性结肠炎的内镜表现），点状多发糜烂及浅溃疡（溃疡性结肠炎的X线征表现），可见黄色黏液覆盖，可以诊断为溃疡性结肠炎，疾病分期为中度，可用柳氮磺吡啶治疗（D对）。环孢素和甲硝唑不属于溃疡性结肠炎的治疗（AC错）。